能实现有效气体交换的通气量为
A. 肺活量
B. 时间肺活量
C. 每分通气量
D. 肺总量
E. 肺泡通气量

正确答案：E。肺泡通气量

解析：由于无效腔的存在，每次吸入新鲜空气不能全部到达肺泡与血液进行气体交换，因而肺通气量不能全面反映气体交换的状况。为了计算真正有效气体交换的通气量，应用肺泡通气量（E对）：肺泡通气量=（潮气量-无效腔）×呼吸频率。肺活量（A错）是指尽力吸气后，从肺内所能呼出的气体量。时间肺活量（1秒用力呼气量）（B错）是指尽力最大吸气后，再尽力尽快呼气，第一秒所能呼出的最大气体量。每分通气量（肺通气量）（C错）是指每分钟吸入或呼出的气体总量，等于潮气量与呼吸频率的乘积。肺容量（D错）是肺所能容纳的最大气体量。